二陈丸的药物组成是
A. 陈皮、半夏、茯神、甘草
B. 陈皮、厚朴、茯苓、甘草
C. 陈皮、半夏、苦杏仁、甘草
D. 陈皮、半夏、茯苓、甘草
E. 化橘红、半夏、茯苓、甘草

正确答案：D。陈皮、半夏、茯苓、甘草

解析：本题考查的是二陈丸的药物组成。二陈丸的药物组成是陈皮、半夏、茯苓、甘草（D对）。二陈丸：【药物组成】半夏（制）、陈皮、茯苓、甘草。香砂养胃颗粒：【药物组成】白术、木香、砂仁、豆蔻（去壳）、广藿香、陈皮、厚朴（姜制）、香附（醋制）、茯苓、枳实（炒）、半夏（姜制）、甘草（B错）、生姜、大枣。橘红丸：【药物组成】化橘红、浙贝母、陈皮、半夏（制）、茯苓、苦杏仁、紫苏子（炒）、桔梗、紫菀、款冬花、瓜蒌皮、石膏、地黄、麦冬、甘草（CE错）。药物组成为陈皮、半夏、茯神、甘草（A错）的中成药，2022年考试指南未明确说明。